布鲁菌不经过哪条途径侵入人体
A. 皮肤
B. 黏膜
C. 呼吸道
D. 消化道
E. 节肢动物叮咬

正确答案：E。节肢动物叮咬

解析：人类主要通过为病畜接生羊羔或牛犊等接触病畜及其分泌物，或接触被污染的畜产品，病菌经皮肤、黏膜、眼结膜、消化道、呼吸道等不同途径感染布鲁氏菌。掌握“动物源性细菌”知识点。